舌骨上肌群不包括
A. 二腹肌
B. 胸骨舌骨肌
C. 颏舌骨肌
D. 茎突舌骨肌
E. 下颌舌骨肌

正确答案：B。胸骨舌骨肌

解析：舌骨上肌群不包括胸骨舌骨肌，舌骨上肌群：包括二腹肌、下颌舌骨肌、颏舌骨肌和茎突舌骨肌。主要作用为降下颌作用。掌握“咀嚼肌、颈部肌及口颌系统肌链”知识点。